乳牙早失的原因,叙述正确的是
A. 严重龋病,牙髓病和根尖周病
B. 恒牙异位萌出，乳牙根过早吸收
C. 外伤导致
D. 先天性牙齿缺失
E. 以上均正确

正确答案：E。以上均正确

解析：本题考查乳牙早失的原因。乳牙早失的原因,叙述正确的是严重龋病,牙髓病和根尖周病；恒牙异位萌出，乳牙根过早吸收；外伤导致；先天性牙齿缺失，所以以上均正确（E对）。乳牙早失的原因：（1）因严重的龋病、牙髓病及根尖周病变而被拔除（A对）；（2）恒牙异位萌出，造成乳牙牙根过早吸收脱落（B对）；（3）牙齿因外伤脱落（C对）；（4）还有一些乳牙是先天性的牙齿缺失（D对）。（ABCD均对，故E为本题的正确答案）。